机体免疫系统受到抗原刺激后，淋巴细胞特异性识别抗原分子，发生活化、增殖、分化并清除抗原的全过程，称为
A. 抗原提呈
B. 免疫应答
C. 补体激活
D. 单克隆抗体
E. 多克隆抗体

正确答案：B。免疫应答

解析：免疫应答是指机体免疫系统受到抗原刺激后，淋巴细胞特异性识别抗原分子，发生活化、增殖、分化，并清除抗原的全过程。掌握“免疫应答基本概念、固有及适应性免疫应答”知识点。